治疗喘证表寒肺热证，应首选
A. 射干麻黄汤
B. 三子养亲汤
C. 定喘汤
D. 厚朴麻黄汤
E. 麻杏石甘汤

正确答案：E。麻杏石甘汤

解析：喘证表寒肺热证是由于寒邪束表，热郁于肺，肺气上逆，治疗时应解表清里，化痰平喘，能够宣肺泄热、降气平喘的麻杏石甘汤最为合适。（E对）。射干麻黄汤为哮病冷哮证的选方，功能温肺化饮，止哮平喘（A错）。三子养亲汤为哮病风痰哮证的选方，亦可合二陈汤治疗喘证痰浊阻肺证，功能涤痰利窍，降气平喘（B错）。定喘汤为哮病热哮证的选方，功能清热宣肺，化痰平喘（C错）。厚朴麻黄汤为哮病寒包热哮证的选方，功能宣肺降逆，清化热痰（D错）。